缺铁性贫血早期最可靠的依据是
A. 血清铁减少
B. 血清铁蛋白降低
C. 血清总铁结合力增高
D. 运铁蛋白饱和度降低
E. 红细胞内原卟啉增高

正确答案：B。血清铁蛋白降低

解析：选项中所有的指标都可以在缺铁性贫血中出现，但只有血清铁蛋白降低能在缺铁性贫血早期出现（B对），血清铁减少（A错）、血清总铁结合力增高（C错）、运铁蛋白饱和度降低（D错）、红细胞内原卟啉增高（E错）都是在缺铁性贫血晚期才能出现。